CO造成机体缺O₂的主要机制是
A. 血液运O₂能力降低
B. 组织利用O₂的能力降低
C. HbO₂的解离速度降低
D. HbCO的形成
E. CO和O₂竞争Hb

正确答案：D。HbCO的形成